不属于性格特征的是
A. 对现实的态度特征
B. 意志特征
C. 情绪特征
D. 应激特征
E. 智力特征

正确答案：D。应激特征